患儿，3岁。面色萎黄，困倦乏力，不思乳食，食则饱胀，呕吐酸馊，大便溏薄酸臭。其治法是
A. 消乳消食，和中导滞
B. 健脾和胃，消食导滞
C. 和脾助运，降逆止呕
D. 补土抑木，消食导滞
E. 健脾助运，消补兼施

正确答案：E。健脾助运，消补兼施

解析：患儿符合积滞的特征：不思乳食，食而不化，脘腹胀满，嗳气酸腐，大便溏薄或秘结酸臭，其脾气虚弱故见面色萎黄，困倦乏力，夹积故见饱胀、呕吐酸馊，治宜健脾助运，消补兼施（E对）。七版教材中治宜健脾助运，消食化滞。消乳消食，和中导滞适用于积滞之乳食内积证（A错）。健脾和胃，消食导滞适用于泄泻之伤食泻（B错）。和脾助运，降逆止呕适用于呕吐兼见脾虚不运（C错）。本患儿未见肝木乘脾土的症状，其脾虚为主，故不用补土抑木（E错）。